评价食物蛋白质营养价值，应考虑
A. 蛋白质含量
B. 消化率
C. 利用率
D. 氨基酸模式
E. 以上都包括

正确答案：E。以上都包括